矽尘致肺癌的调查属于
A. 劳动卫生基本情况调查
B. 回顾性调查
C. 专题调查
D. 前瞻性调查
E. 事故调查

正确答案：C。专题调查